下列不具有抗龋作用的矿物质或元素是
A. 氟
B. 磷酸盐
C. 硒
D. 镁
E. 铁

正确答案：D。镁

解析：本题考查龋病发生的食物因素-无机盐。镁（D错，为本题的正确答案）元素与牙齿的抗龋无关，反而有增加机体对龋病敏感性的作用。矿物质或元素在一定程度上具有防龋的功能，氟与龋病的关系最为密切，适量的氟（A对）可以防龋。磷酸盐（B对）能促进牙体硬组织的再矿化，增强牙齿的强度，有利于增加牙齿对龋病的抵御力。硒（C对）、铁（E对）的摄入均有利于牙齿抗龋。